石棉肺X线胸片的主要表现为
A. 类圆形小阴影和胸膜改变
B. 不规则型小阴影和胸膜改变
C. 大阴影和胸膜改变
D. 不规则型小阴影和肺纹理的改变
E. 类圆形和不规则型小阴影及肺纹理的改变

正确答案：B。不规则型小阴影和胸膜改变

解析：本题考查石棉肺的X线表现。石棉肺主要表现为不规则形小阴影和胸膜改变（B对ACDE错）。不规则形小阴影是石棉肺X线表现的特征，也是石棉肺诊断分期的主要依据。